下列盆腔检查（妇科检查）中操作正确的是
A. 检查者不必告知被检查者盆腔检查可能引起不适
B. 作宫颈刮片或阴道分泌物涂片细胞学检查时，不宜用润滑剂，必要时可用生理盐水润滑
C. 应避免于经期作盆腔检查，阴道异常流血也不能进行盆腔操作
D. 双合诊的目的在于检查阴道、宫颈、宫体、输卵管和卵巢的形状
E. 外阴部检查不能发现阴道前后壁脱垂、子宫脱垂或尿失禁

正确答案：B。作宫颈刮片或阴道分泌物涂片细胞学检查时，不宜用润滑剂，必要时可用生理盐水润滑

解析：本题考查盆腔检查的操作。检查时检查者应该告知被检查者盆腔检查可能引起不适。做宫颈刮片或者阴道上1/3段涂片细胞学检查，则不宜用润滑剂，以免影响检查结果，必要时可改用生理盐水润滑（B对ACDE错）。应避免于经期做盆腔检查，但若为异常出血则必须检查。在进行外阴部检查时，还应让患者用力向下屏气，观察有无阴道前壁或后壁膨出、子宫脱垂或尿失禁等。双合诊：检查者用一手的两指或一指放入阴道，另一手在腹部配合检查的方法，盆腔检查中最重要、最常用的方法。主要目的在于检查阴道、宫颈、子宫、输卵管、卵巢及宫旁结缔组织和韧带，以及盆腔内壁有无异常。